真热假寒的病机特点是
A. 阴盛格阳
B. 阳盛格阴
C. 阳虚阴盛
D. 阴虚阳盛
E. 阴损及阳

正确答案：B。阳盛格阴

解析：真热假寒是由于体内阳气太盛，在体内壅遏，阴气在外所造成的（B对）。阴盛格阳是真寒假热的病机特点（A错）。阳虚阴盛只有真寒无假热表现（C错）。阴虚阳盛只有真热无假寒表现（D错）。阴损及阳，指由于阴气亏损，累及阳气生化不足，在阴虚的基础上又出现阳虚，形成以阴虚为主的阴阳两虚的病机变化（E错）。